男，35岁。纳差、腹胀2个月。查体：浅表淋巴结未触及，巩膜无黄染，肝肋下未触及，脾肋下8.5cm，质硬。化验血常规：Hb100g/L，WBC67.7×10⁹/L，原始细胞0.02，早幼粒细胞0.02，中幼粒细胞0.13，晚幼粒细胞0.18，杆状核粒细胞0.08，分叶粒细胞0.37，E0.06，B0.09，L0.04，M0.01，Plt543×10⁹/L。应首选的治疗药物是
A. 羟基脲，甲磺酸伊马替尼
B. 亚砷酸，全反式维A酸
C. 苯丁酸氮芥，糖皮质激素
D. 维生素B₁₂，叶酸
E. 沙利度胺，红细胞生成素

正确答案：A。羟基脲，甲磺酸伊马替尼

解析：男性患者，35岁，白细胞计数WBC67.7×10⁹/L（超过20×10⁹ /L），血片中可见各阶段粒细胞，以中幼、晚幼和杆状粒细胞居多，E（嗜酸性粒细胞百分率）：0.06（正常值0.01-0.05），B（嗜碱粒细胞百分率）：0.09（正常值0-0.02），PLT543×10⁹/L（正常值100-300×10⁹/L，增高）。患者脾肋下8.5cm（脾大）。根据患者病史，体征和实验室检查可诊断为慢性髓细胞白血病。羟基脲、甲磺酸伊马替尼（A对）可用于治疗慢性髓细胞白血病。维生素B12、叶酸（D错）用于治疗巨幼细胞性贫血。苯丁酸氮芥、糖皮质激素（C错）用于治疗慢性淋巴细胞白血病。沙利度胺、红细胞生成素（E错）用于治疗多发性骨髓瘤。亚砷酸、全反式维A酸（B错）用于治疗急性早幼粒细胞白血病。